心腔结构的描述中，错误的是
A. 上腔静脉开口于右心房
B. 冠状窦开口于左心房
C. 肺静脉开口于左心房
D. 主动脉开口于左心室
E. 肺动脉开口于右心室

正确答案：B。冠状窦开口于左心房

解析：右心房内有上腔静脉开口（A对）、冠状窦开口（B错，为本题正确答案）。左心房内有肺静脉开口（C对）。左心室内有主动脉开口（D对）。右心室内有肺动脉开口（E对）。